下列哪项属于学校开展健康教育工作时营造健康环境的内容
A. 安排学生健康教育课
B. 组织学生参观禁毒展览
C. 为学生进行健康体检
D. 改造学生食堂
E. 组织学生秋季运动会

正确答案：D。改造学生食堂